男，42岁，劳累时心悸气短2年，腹胀、尿少3天。心电图示心房颤动，心室率110次/分；胸部X线示心胸比值65％，肺瘀血。有助于该患者诊断的辅助检查是
A. 心电图
B. 超声心动图
C. 心导管检查
D. 心电图运动负荷试验
E. 心脏核素检查

正确答案：B。超声心动图

解析：患者中年男性，劳累时心悸气短，腹胀尿少，胸部X线示心胸比值65％（正常值＜50%，提示心界扩大），肺瘀血，均为慢性左心衰竭常见表现。心电图示心房颤动，心室率110次/分（正常值60～100次/分，偏快），本患者考虑诊断为心房颤动伴慢性左心衰竭。有助于该患者诊断的辅助检查是超声心动图（B对），其可观察各心腔大小变化和评估心功能，是诊断心力衰竭最主要的仪器检查。心电图（A错）主要了解是否存在各种心律失常、心肌缺血或梗死、房室肥大或电解质紊乱等，且本患者已有心电图记录。心导管检查（C错）为有创介入技术，主要用于急性重症患者。心电图运动负荷试验（P220）（D错）是指增加心脏负荷以激发心肌缺血，主要用于诊断冠心病。心脏核素检查（P169）（E错）常用于评价心肌的存活状态，在测量心室容积或更精细的心功能指标方面价值有限。